尿道损伤合并尿外渗及阴囊血肿时，有效的治疗方法是
A. 导尿
B. 经会阴尿道吻合+清除血肿及尿外渗
C. 清除会阴部血肿
D. 耻骨上膀胱造瘘
E. 经会阴尿道修补

正确答案：B。经会阴尿道吻合+清除血肿及尿外渗

解析：尿道损伤合并尿外渗及阴囊血肿时，考虑为尿道断裂，有效的治疗方法是经会阴尿道吻合，留置导尿管3周，并清除血肿及尿外渗（B对）。导尿会加重尿道损伤（A错）。单纯清除会阴部血肿不能达到治疗目的（C错）。耻骨上膀胱造瘘不能解决阴囊血肿且达不到治疗效果（D错）。经会阴尿道修补适用于尿道部分裂伤，不用于尿道断裂（E错）。